健脾丸的主要配伍特点是
A. 补气健脾与渗湿止泻同用
B. 补气健脾与涩肠止泻同用
C. 补气健脾与消食行气同用
D. 补气健脾与行气利湿同用
E. 补气健脾与清热除湿同用

正确答案：C。补气健脾与消食行气同用

解析：健脾丸方含白术、茯苓、人参、山药、肉豆蔻、炙甘草，以益气健脾；神曲、山楂、炒麦芽，以消食；佐以木香、砂仁、陈皮，理气开胃。为补气健脾与消食行气兼施之剂（C对），但补重于消，且补而不滞，消不伤正，主治脾虚食积证。